除另有规定外，普通药材的酊剂每100ml相当于原药材
A. 1g
B. 2～5g
C. 10g
D. 20g
E. 60g

正确答案：D。20g